下列各项，属天王补心丹组成药物的是
A. 西洋参
B. 丹参
C. 沙参
D. 党参
E. 苦参

正确答案：B。丹参

解析：该题考查天王补心丹的组成。天王补心丹中的“三参”分别为人参、玄参、丹参（B对）。记忆：补心丹用柏枣仁，二冬生地当归身，三参桔梗朱砂味，远志茯苓养心神。